温度刺激出现短暂的轻度或中度的不适或疼痛，表明
A. 牙髓正常
B. 牙髓坏死
C. 可复性牙髓炎
D. 急性牙髓炎
E. 慢性牙髓炎

正确答案：A。牙髓正常

解析：本题考查牙髓温度测验。温度刺激出现短暂的轻度或中度的不适或疼痛，表明牙髓正常（A对）。可复性牙髓炎（C错）、急性牙髓炎即不可复性牙髓炎（D错）和慢性牙髓炎（E错）对温度刺激均有疼痛明显症状，而非不适，牙髓坏死（B错）则有冷热刺激史，故牙髓应该正常。